28岁初产妇，妊娠40周，于晨4时临产，13时宫口开大4cm，21时30分宫口开大7cm，此时应诊断为
A. 潜伏期延长
B. 活跃期延长
C. 活跃期停滞
D. 第二产程停滞
E. 第二产程延长

正确答案：B。活跃期延长

解析：该孕妇，从宫口4cm到开大至7cm用时8.5小时（超过8小时），故诊断为活跃期延长（B对）。潜伏期是指从临产出现规律宫缩至宫口扩张3cm，潜伏期延长（A错）是指潜伏期超过16小时。活跃期停滞（C错）是指活跃期宫口扩张停止＞4小时。无第二产程停滞（D错）的说法。第二产程延长（E错）是指初产妇第二产程＞2小时（硬膜外麻醉无痛分娩时以超过3小时为准），经产妇第二产程＞1小时。